男，30岁。溺水后发生急性呼吸窘迫综合征。给予气管插管、机械通气，潮气量400ml，呼吸频率20次/分，吸呼比1：1.5，PEEP5cmH₂O，吸氧浓度为60%，PaO₂仍低于50mmHg时，应首先调整的呼吸机参数是
A. 增加PEEP水平
B. 增加潮气量
C. 增加呼吸频率
D. 增加吸氧浓度
E. 反比呼吸

正确答案：A。增加PEEP水平

解析：患者溺水后发生急性呼吸窘迫综合征，给予气管插管、机械通气后，PaO₂仍低于50mmHg时，应首先调整的呼吸机参数是增加PEEP水平（A对）。ARDS机械通气采用小潮气量（B错），防止肺泡过度扩张。